以下哪项最不符合成釉细胞瘤X线特征的是
A. 多房且分房大小相差悬殊
B. 骨质膨胀，以向唇颊侧为甚
C. 肿瘤内可见钙化影
D. 牙根可锯齿状或截断状吸收
E. 肿瘤可含牙或不含牙，邻牙可被肿瘤推压而移位

正确答案：C。肿瘤内可见钙化影

解析：本题考查成釉细胞瘤的影像学表现。以下最不符合成釉细胞瘤的X线特征的是肿瘤内可见钙化影（C错，为本题正确答案）。颌骨成釉细胞瘤多呈类圆形，边界清晰；少数可呈不规则形，边界模糊；部分成釉细胞瘤可呈分叶状。X线和CBCT上，成釉细胞瘤有多囊和单囊之分。多囊者其囊的大小可相差悬殊（A对）。除上述影像学表现外，颌骨成釉细胞瘤尚有以下影像表现特点：①颌骨膨胀，以唇颊侧为主（B对）；②牙根呈锯齿状吸收（D对）；③肿瘤可致牙根间的牙槽骨吸收；④肿瘤边缘可有骨硬化增生；⑤瘤区内可有缺牙或牙移位；⑥瘤内可含牙（E对）（多见于单囊型成釉细胞瘤）；⑦钙化或骨化较为少见（除外促结缔组织增生型成釉细胞瘤）。